原发性肾小球疾病的病理分型不包括
A. 轻微病变型肾小球肾炎
B. 系膜增生性肾小球肾炎
C. 膜性肾病
D. 肾病综合征
E. 硬化性肾小球肾炎

正确答案：D。肾病综合征

解析：原发性肾小球肾炎的病理分型根据WHO分类标准分为：1.轻微肾小球病变（A对）。2.局灶节段性病变，包括局灶性肾小球肾炎。3.弥漫性肾小球肾炎（1）膜性肾病（C对）；（2）增生性肾炎：①系膜增生性肾小球肾炎（B对）；②毛细血管内增生性肾小球肾炎；③系膜毛细血管性肾小球肾炎，又称为膜增生性肾小球肾炎；④新月体性和坏死性肾小球肾炎；（3）硬化性肾小球肾炎（E对）。4.未分类的肾小球肾炎。肾病综合征（D错，为本题正确答案）属于原发性肾小球肾炎的临床分型。